患者31岁。12月末发病，头痛、发热、恶心、呕吐，腰痛4天，查体：面色潮红，结膜充血，腋下可见点状出血，化验：白细胞15×10⁹/L，中性粒细胞72%，淋巴细胞20%，异淋8%，尿蛋白（+++），己确诊为肾综合征出血热。此时哪项分期更准确
A. 发热期
B. 休克期
C. 发热末期
D. 少尿初期
E. 移行期

正确答案：A。发热期

解析：患者头痛、发热、恶心、呕吐（全身中毒症状），腰痛4天（C错），面色潮红，结膜充血，腋下可见点状出血（毛细血管损伤征），实验室检查白细胞15×10⁹/L（成人正常参考值4～10×10⁹/L），中性粒细胞72%，淋巴细胞20%，异性淋巴细胞8%，尿蛋白（+++）（肾损害征），根据患者的临床症状、体征和实验室检查，患者处于发热期（A对）。休克期（B错）多发生在发热末期或退热同时出现血压下降时，少数发生在退热后，可见脸色苍白，四肢厥冷，脉搏细弱或不能触及，尿量减少，严重时会出现发燥、谵妄、神志恍惚，顽固性休克患者会并发DIC、脑水肿、ARDS和急性肾衰竭（P80）。少尿初期（D错）常继低血压休克期而出现，亦可与低血压休克期重叠或由发热期直接进入，主要表现为尿毒症、酸中毒和水、电解质紊乱，严重者可出现高血容量综合征和肺水肿，表现为厌食、恶心、呕吐、腹胀和腹泻等，常有顽固性呃逆，可出现头晕、头痛、烦躁、嗜睡。谵妄甚至昏迷和抽搐等症状（P80-P81）。移行期（E错）属于多尿期，多发生在病程9～14天，每天尿量由400ml增至2000ml，尿量增加，但血尿素氮和肌酐会升高，症状加重。